出现心衰细胞的是
A. 慢性肺源性心脏病
B. 高血压心脏病伴左心功能不全
C. 扩张性心肌病
D. 风湿性心脏病
E. 病毒性心肌炎

正确答案：B。高血压心脏病伴左心功能不全

解析：心衰细胞是指慢性肺淤血时，肺泡腔内所见的含有含铁血黄色的巨噬细胞，而慢性肺淤血通常由心脏病变（如高血压心脏病）伴左心功能不全（B对）引起，是由于左心功能不全导致左心腔内压力升高，阻碍了肺静脉的回流。慢性肺源性心脏病（P177）（A错）的主要表现为肺小动脉的变化，特别是肺腺泡内小血管构型的重建。扩张性心肌病（P149）（C错）的镜下表现主要为心肌细胞不均匀性肥大、伸长，肥大和萎缩的心肌细胞交错排列。风湿性心脏病（P144）（D错）的典型表现为风湿小体（Aschoff小体）的形成。病毒性心肌炎（P153）（E错）的镜下表现主要为心肌细胞间质水肿，可见淋巴细胞和单核细胞浸润，伴有心肌间质纤维化等。